慢性肾衰竭患者常出现的电解质紊乱是
A. 高磷血症，低钙血症
B. 低磷血症，低钙血症
C. 低磷血症，高钙血症
D. 低磷血症，高钾血症
E. 低钾血症，高钙血症

正确答案：A。高磷血症，低钙血症

解析：慢性肾衰竭患者常出现的电解质紊乱是高磷血症和低钙血症。慢性肾衰竭是肾小球滤过率下降、尿磷排出减少会引起血磷增高，高血磷与血钙结合成磷酸钙沉积于软组织，导致软组织异常钙化，并使血钙降低（A对）。